颈外动脉平下颌角高度发出
A. 大脑中动脉
B. 甲状腺上动脉
C. 面动脉
D. 咽升动脉
E. 上颌动脉

正确答案：C。面动脉

解析：面动脉（C对）为颈外动脉平下颌角高度发出的分支，于咬肌止点的前缘绕过下颌骨下缘至面部。